目前认为某些有害物无阈值，它们是
A. 引起急性中毒的毒物
B. 引起慢性中毒的毒物
C. 致敏物
D. 环境致畸物
E. 遗传毒性致癌物

正确答案：E。遗传毒性致癌物

解析：本题考查无阈值化合物。无阈值化合物是指在大于零的剂量暴露下，均可能发生有害效应的化合物，
其剂量反应曲线的延长线通过坐标的原点，认为这类化合物无安全剂量。 在健康危险度评价实践
中，遗传毒性致癌物（E对ABCD错）均视为无阈值化合物。